患儿，6岁。泄泻1天，泻下稀薄如水注，粪色深黄臭秽，夹有少量黏液，腹部时感疼痛，食欲减退，恶心欲吐，口渴引饮，舌红苔黄腻。其证候是
A. 脾肾阳虚泻
B. 伤食泻
C. 风寒泻
D. 湿热泻
E. 脾虚泻

正确答案：D。湿热泻

解析：患儿泄泻1天，泻下稀薄如水注，粪色深黄臭秽，夹有少量黏液，腹部时感疼痛，食欲减退，恶心欲吐，口渴引饮，舌红苔黄腻，诊断为湿热泻（D对）。脾肾阳虚泻以大便澄澈清冷，完谷不化，形寒肢冷为特征（A错）。伤食泻以起病前有乳食不节史，便稀夹不消化物，气味酸臭，脘腹胀痛，泻后痛减为特征（B错）。风寒泻以大便清稀夹有泡沫，臭气不甚，肠鸣腹痛为特征（C错）。脾虚泻以病程较长，大便稀溏，多于食后作泻，以及全身脾虚征象为特征（E错）。